肌内注射给药时，药物释放从快到慢的正确排列顺序是
A. O/W乳剂>水溶液>水混悬液>W/O乳剂
B. 水溶液>水混悬液>O/W乳剂>W/O乳剂
C. W/O乳剂>O/W乳剂>水溶液>水混悬液
D. 水溶液>O/W乳剂>W/O乳剂>水混悬液
E. O/W乳剂>水溶液>W/O乳剂>水混悬液

正确答案：D。水溶液>O/W乳剂>W/O乳剂>水混悬液